阿司匹林遇湿气即缓慢溶解，《中国药典》规定其游离水杨酸允许限度为0.1%，适宜的贮存条件是
A. 避光，在阴凉处保存
B. 遮光，在阴凉处保存
C. 密闭，在干燥处保存
D. 密封，在干燥处保存
E. 熔封，在凉暗处保存

正确答案：D。密封，在干燥处保存

解析：本题考查药品贮藏的相关要求。阿司匹林遇湿气即缓缓水解，《中国药典》规定其游离水杨酸允许限度为0.1%，适宜的贮存条件是密封，在干燥处保存（D对）。避光（A错）或者遮光（B错），在阴凉处保存的一般是对光线比较敏感的药品，如硝普钠。除另有规定外，药品应避光、密闭（C错）保存。熔封（E错）主要应用于注射剂、冲洗剂等无菌制剂的包装，暗处是指贮藏处避光且温度不超过20℃。